女，60岁。乳腺癌根治术后3天，大便后起立时突感呼吸困难，随即意识丧失，呼吸及大动脉搏动消失。立即给予心肺复苏，呼吸道吸出血性液体。最可能的情况是
A. 急性心肌梗死
B. 乳腺癌肺转移
C. 肺血栓栓塞
D. 自发性气胸
E. 心源性休克

正确答案：C。肺血栓栓塞

解析：患者术后3天，活动后突感呼吸困难，随即意识丧失，呼吸及大动脉搏动消失（提示昏厥），呼吸道吸出血性液体（提示可能出现肺内出血），其最可能的情况是肺血栓栓塞（C对）。肺血栓栓塞常发生于骨折或手术后，表现为活动后突然出现的呼吸困难、胸痛、昏厥、咯血等症状。急性心肌梗死（A错）常有先兆症状，如发病前数日乏力、胸部不适等，首发症状为胸痛，随病情的进展而出现全身其他系统表现，最终出现低血压和休克。乳腺癌肺转移（B错）见于乳癌晚期，且为慢性进展性疾病，不会出现突发性的呼吸困难、昏厥。自发性气胸（D错）表现为突发胸痛，多局限于患侧，严重者也会出现呼吸困难，休克等症状，查体可见患侧胸廓饱满、叩诊呈鼓音。心源性休克（E错）是由于心脏功能减退，外周循环衰竭而引发的休克，为渐进性疾病，常表现为面色苍白、四肢厥冷、血压下降、脉细速、神志不清或昏迷等症状，不会出现突发性的呼吸困难。